下列局部麻醉药中表面麻醉作用最强的是
A. 2％盐酸丁卡因
B. 4％盐酸可卡因
C. 0.5％盐酸达克罗宁
D. 0.5％布比卡因
E. 2％利多卡因

正确答案：A。2％盐酸丁卡因

解析：本题考查表面麻醉作用最强的局麻药。以普鲁卡因的麻醉效果作为标准，2％盐酸丁卡因（A对）是普鲁卡因麻醉效果的10倍，0.5％布比卡因（D错）是普鲁卡因麻醉效果的8倍，2％利多卡因（E错）是普鲁卡因麻醉效果的2倍，4％盐酸可卡因（B错）的麻醉效果大于普鲁卡因，但不如2％盐酸丁卡因，故在这五种局麻药物中，2％盐酸丁卡因的表面麻醉作用最强。0.5％盐酸达克罗宁（C错）是局麻药，用于黏膜表面麻醉及皮肤镇痛、止痒，麻醉作用很小。丁卡因跟地卡因是同一种药物。